关于佐剂的叙述，下列哪项错误
A. 佐剂是特异性免疫增强剂
B. 与免疫原混合后可增强抗原在体内存留时间
C. 最常用于动物实验的是弗氏佐剂和弗氏不完全佐剂
D. 可刺激巨噬细胞（Mφ），增加它对抗原的处理和提呈
E. 可刺激淋巴细胞的增生和分化

正确答案：A。佐剂是特异性免疫增强剂